以下哪种组织结构中分布着触觉和痛觉感受器
A. 牙釉质
B. 牙本质
C. 牙骨质
D. 牙周膜
E. 牙槽骨

正确答案：D。牙周膜

解析：牙周膜内分布有触觉（压觉）感受器和疼痛感受器，前者可传导压力和轻微接触牙体的外部刺激，发挥本体感受功能；而后者可传导痛觉，参与防御反应。掌握“根尖周病概述”知识点。